钙通道阻滞剂氨氯地平引起的主要不良反应是
A. 低钾血症
B. 高钾血症
C. 高镁血症
D. 心律失常
E. 踝足肿胀

正确答案：E。踝足肿胀

解析：本题考查药物的不良反应。钙通道阻滞剂氨氯地平引起的主要不良反应是踝足肿胀（E对）。二氢吡啶类钙通道阻滞剂（氨氯地平）常见不良反应包括：反射性交感神经激活导致心跳加快、面部潮红、脚踝部水肿、牙龈增生等。低钾血症（A错）是噻嗪类利尿药的不良反应。高钾血症（B错）醛固酮受体阻断剂的不良反应。